肠伤寒的肠溃疡特征
A. 溃疡呈环形与肠的长轴垂直
B. 溃疡呈长椭圆形与肠的长轴平行
C. 溃疡呈烧瓶状口小底大
D. 溃疡边缘呈堤状隆起
E. 溃疡表浅呈地图状

正确答案：B。溃疡呈长椭圆形与肠的长轴平行

解析：肠伤寒的肠溃疡特征是溃疡呈长椭圆形，其长轴与肠的长轴平行（B对）。溃疡呈环形，其长轴与肠的长轴垂直（A错）是肠结核（P356）的病变特征。溃疡呈烧瓶状口小底大（C错）是肠阿米巴病（P369）的病变特征。溃疡边缘呈堤状隆起（D错）是癌性溃疡（P210）的病变特征。溃疡表浅呈地图状（E错）是细菌性痢疾（P360）的病变特征。